社会经济发展过程中，由于对资源不合理的开采和利用，使得什么对人类健康产生重大威胁
A. 环境污染
B. 生活方式
C. 现代文明病
D. 心理健康
E. 人口流动

正确答案：A。环境污染